可引起胃溃疡的细菌是
A. 铜绿假单胞菌
B. 幽门螺杆菌
C. 产气荚膜梭菌
D. 金黄色葡萄球菌
E. 军团菌

正确答案：B。幽门螺杆菌

解析：可能引起胃溃疡的细菌是幽门螺杆菌（B对），它与胃窦炎、十二指肠溃疡、胃溃疡，胃腺癌和胃黏膜相关B淋巴细胞瘤的发生等发病密切，一旦定植，由其导致的炎症及可持续数年或数十年，甚至一生，绝大多数病人可患胃溃疡或十二指肠溃疡。